Cariostat试验检测培养液颜色为黄色，表示
A. 口腔卫生良好
B. 低度龋活性
C. 中度龋活性
D. 危险龋活性
E. 明显龋活性

正确答案：E。明显龋活性

解析：本题考查Cariostat试验。Cariostat试验检测培养液颜色为黄色，表示明显龋活性（E对）。Cariostat试验：1.目的：检测牙表面菌斑内产酸菌的产酸能力。2.试剂盒：含溴甲酚紫及溴甲酚绿的液体培养管、标准棉签。3.检测方法：用标准棉签涂擦一侧牙颊面菌斑4～5次，将棉签放置培养管内，37℃，48小时培养，观察培养液颜色变化。4.结果判断：蓝紫色（-）；绿色（+）；黄绿色（++）；黄色（+++）。（++）培养管内pH5.0～5.5为危险龋活性，（+++）为明显龋活性。